五苓散的药物组成有
A. 猪苓、茯苓、桂枝、苍术、泽泻
B. 茯苓、猪苓、桂枝、泽泻、白术
C. 猪苓、茯苓、泽泻、滑石、甘草
D. 猪苓、茯苓、泽泻、阿胶、滑石
E. 茯苓、泽泻、甘草、大枣、桂枝

正确答案：B。茯苓、猪苓、桂枝、泽泻、白术

解析：五苓散治太阳腑，白术泽泻猪苓茯，桂枝化气兼解表，小便通利水饮除（B对）。五苓散的功用为利水渗湿，温阳化气，主治蓄水证；痰饮；水湿内停证。